修复缺失患牙属于
A. 基本急诊保健
B. 牙周病一级预防
C. 牙周病二级预防
D. 牙周病三级预防
E. 社区牙周保健

正确答案：D。牙周病三级预防

解析：三级预防是在牙周病发展到严重和晚期阶段所采取的治疗措施以及修复失牙，重建功能；并通过随访、口腔健康的维护，维持其疗效，预防复发。掌握“牙周病流行病学及分级预防”知识点。